成年男性患者，被确诊为HIV感染者，消瘦衰竭经常发生肺感染，造成免疫低下机制主要是
A. 神经胶质细胞减少
B. 树突状细胞减少
C. 吞噬细胞被破坏
D. 中和抗体保护作用低
E. CD4⁺T细胞大量被破坏

正确答案：E。CD4⁺T细胞大量被破坏